对收受药品生产经营企业或其代理人财物且情节严重的医师，卫生计生行政部门应当作出的处理是
A. 注销执业证书
B. 暂停执业活动
C. 吊销执业证书
D. 记过
E. 警告

正确答案：C。吊销执业证书

解析：对收受药品生产经营企业或其代理人财物且情节严重的医师，卫生计生行政部门应当作出的处理是吊销其执业证书（C对D错），医师受到吊销执业证书处罚后，其所在医疗、预防、保健机构报告卫生行政部门，卫生行政部门予注销其执业证书（A错）。暂停执业活动（B错）、警告（E错）是在医师收受患者财物时卫生行政部门给予的处理（P250）。